属于植物来源的半合成生物碱的抗肿瘤药是
A. 多柔比星
B. 拓扑替康
C. 甲氨蝶呤
D. 雷帕霉素
E. 奥沙利铂

正确答案：B。拓扑替康

解析：本题考查抗肿瘤药。属于植物来源的半合成生物碱的抗肿瘤药是拓扑替康（B对）。植物来源的抗肿瘤的生物碱包括：①喜树碱类：如喜树碱、羟喜树碱、拓扑替康；②长春新碱类：如长春碱、长春新碱和长春瑞滨；③高三尖杉酯碱类：如高三尖杉酯碱。多柔比星（A错）属蒽环类抗肿瘤抗生素。甲氨蝶呤（C错）属抗代谢物抗肿瘤药。雷帕霉素（D错）是大环内酯类免疫抑制剂。奥沙利铂（E错）为铂类化合物。